阴道后邻
A. 膀胱和尿道
B. 直肠
C. 乙状结肠
D. 尿生殖膈
E. 盆膈

正确答案：B。直肠

解析：阴道位于小骨盆中央，前邻膀胱和尿道（A错），后邻直肠（B对），阴道下部穿经尿生殖隔（D错）。